血浆消除半衰期相对较长（14～16min），可间隔30min静脉注射2次给药的溶栓药物是
A. 重组链激酶
B. 尿激酶
C. 瑞替普酶
D. 替奈普酶
E. 阿替普酶

正确答案：C。瑞替普酶

解析：本题考查溶栓药。血浆消除半衰期相对较长（14～16min），可间隔30min静脉注射2次给药的溶栓药物是瑞替普酶（C对）。瑞替普酶血浆半衰期为14～16min，溶栓时静脉注射2次即可，2剂之间间隔30min。重组链激酶（A错）血浆半衰期为5～30min，是抗原性及变态反应风险最高的溶栓药物。尿激酶（B错）血浆半衰期≦20min。替奈普酶（D错）半衰期更长（血浆半衰期20～24min），单次注射给药即可。阿替普酶（E错）半衰期短（<5min），需持续静脉滴注。